β肾上腺素受体阻断药的药理作用是
A. 加快房室传导
B. 减慢心率
C. 松弛支气管平滑肌
D. 迅速增强心肌收缩力
E. 增加脂肪分解

正确答案：B。减慢心率

解析：β肾上腺素受体阻断药的药理作用是减慢心率（B对），延缓房室传导（A错），收缩支气管平滑肌（C错），减弱心肌收缩力（D错），减少脂肪分解（E错）。